心为五脏六腑之大主的理论依据是
A. 心主血
B. 心主神志
C. 心主思维
D. 心主魂魄
E. 心主意志

正确答案：B。心主神志

解析：心的主要生理机能为主血脉和主藏神，而心的主血脉和心藏神的机能主宰人体整个生命活动的作用，故称心为五脏六腑之大主。心主血脉之所以和心为五脏六腑之大主有一定关系，是由于人体各脏腑形体官窍的生理机能，包括神志活动都离不开血气的充养，而血气到达全身是以心脏搏动为动力的。故心主血脉与心为五脏六腑之大主有一定联系，但并非理论依据（A错）。人体的脏腑、经络、形体、官窍。各有不同的生理机能，但他们都必须在心神的主宰和调节下，分工合作，共同完成整体生命活动。心神通过驾驭协调各脏腑之气以达到调控个脏腑机能之目的，因此心为五脏六腑之大主（B对）。思维、魂魄、意志均为心主神志的一个方面（CDE错）。